国际上通用的孕产妇死亡率的计算方法为
A. 期内孕产妇死亡数/期内孕产妇总数×1000‰
B. 期内孕产妇死亡数/期内活产数×1000‰
C. 期内孕产妇死亡数/期内孕产妇总数×100000/10万
D. 期内孕产妇死亡数/期内活产数×100000/10万
E. 期内孕产妇死亡数/期内活产数×100%

正确答案：D。期内孕产妇死亡数/期内活产数×100000/10万

解析：本题考查孕产妇死亡率的计算方法。国际上通用的孕产妇死亡率的计算方法为期内孕产妇死亡数/期内活产数×100000/10万（D对ABCE错），某地某年孕产妇死亡率的分母是某地某年活产总数。